身高体重指数在什么年龄时趋于稳定
A. 18，女16
B. 20，女18
C. 21，女17
D. 21，女19
E. 25，女23

正确答案：D。21，女19